皮质脊髓束叙述错误的是
A. 经内囊后肢下行
B. 大部分纤维交叉至对侧
C. 交叉后的纤维形成皮质脊髓侧束
D. 止于脊髓灰质前角运动细胞
E. 躯干肌仅接受对侧皮质脊髓束纤维

正确答案：E。躯干肌仅接受对侧皮质脊髓束纤维

解析：皮质脊髓束由中央前回上、中部和中央旁小叶前半部等处皮质的锥体细胞轴突集中而成，经内囊后肢下行（A对），大部分纤维交叉至对侧（B对），交叉后的纤维形成皮质脊髓侧束（C对），止于前角运动神经元（D对）。躯干肌是受两侧大脑皮质支配（E错，为本题正确选项）。